收集用药清单，整理医嘱，发现不适当用药并建议调整治疗方案的过程称为
A. 处方审核
B. 药物评价
C. 药物重整
D. 药物等效性评价
E. 药品综合评价

正确答案：C。药物重整

解析：本题考查药物重整。收集用药清单，整理医嘱，发现不适当用药并建议调整治疗方案的过程称为药物重整（C对）。处方审核（A错）是指药师在调剂工作中，首先要审核处方的合法性，然后对处方的规范和完整性、处方的病情诊断与用药的适宜性、用药的合理性进行审核。药物评价（B错）包括：有效性、安全性、药物经济学、质量评价。药品综合评价（E错）是运用卫生技术评估方法及药物常规监测工具，融合循证医学、流行病学、临床医学、临床药学、循证药学、药物经济学、卫生技术评估等知识体系，综合利用药物上市准入、大规模多中心临床试验结果、不良反应监测、医疗卫生机构药物使用监测、药物临床实践“真实世界”数据以及国内、外研究文献等资料，围绕药物的安全性、有效性、经济性、创新性、适宜性、可及性等进行定性与定量数据整合分析。